某颏部外伤患者，曲面体层片显示其下颌中部及双侧髁状突骨折，如果要进一步检查髁状突骨折的内外方向的移位情况，宜投照
A. 许勒位
B. 经咽侧位
C. 下颌骨侧位
D. 下颌骨开口后前位
E. 下颌体腔片

正确答案：D。下颌骨开口后前位

解析：本题考查髁突移位的检查。某颏部外伤患者，曲面体层片显示其下颌中部及双侧髁状突骨折，如果要进一步检查髁状突骨折的内外方向的移位情况，宜投照下颌骨开口后前位（D对）。下颌骨开口后前位片主要用于对比观察两侧髁突内外径向的影像。许勒位（A错）显示颞下颌关节外侧1/3侧斜位影像，颞骨岩部投影于髁突的下方，可以同时显示关节窝、关节结节、髁突及关节间隙，两侧颞下颌关节的形态一般是对称的。经咽侧位（B错）可清楚地显示髁突前后斜侧位影像。下颌骨侧位（C错）此片可清楚地显示下颌骨体磨牙区及下颌升支，常用于观察下颌骨体、升支及髁突的病变。下颌体腔片（E错）可显示下颌全部牙列及周围的颌骨情况。